龈上菌斑形成过程正确的顺序是
A. 获得性膜形成→初期聚集→细菌迅速生长繁殖→菌斑成熟
B. 初期聚集→获得性膜形成→细菌迅速生长繁殖→菌斑成熟
C. 初期聚集→细菌迅速生长繁殖→获得性膜形成→菌斑成熟
D. 获得性膜形成→细菌迅速生长繁殖→初期聚集→菌斑成熟
E. 初期聚集→细菌迅速生长繁殖→菌斑成熟

正确答案：A。获得性膜形成→初期聚集→细菌迅速生长繁殖→菌斑成熟

解析：本题考查龈上菌斑的形成过程。龈上菌斑形成过程正确的顺序是获得性膜形成→初期聚集→细菌迅速生长繁殖→菌斑成熟（A对）。牙菌斑形成的先驱是获得性膜形成（BCE错），牙面获得性膜形成后，很快便有细菌黏附聚集（D错），牙面经清洁处理后8小时至2天内细菌迅速生长，已在获得性膜上牢固附着的细菌自身繁殖，约2天后菌斑开始成形，随着时间的延长细菌的数量和结构逐渐趋于稳定，最终菌斑成熟。综上所述，龈上菌斑形成过程正确的顺序是：获得性膜形成→初期聚集→细菌迅速生长繁殖→菌斑成熟。